下列不属于目前生命质量评价主要应用的领域是
A. 慢性病患者健康评价与治疗决策
B. 人群健康状况的测定与评价
C. 药效评价和卫生管理决策
D. 基础病理研究

正确答案：D。基础病理研究

解析：本题考查生命质量评价主要应用的领域。目前生命质量评价主要应用的领域有：慢性病患者健康评价与治疗决策（A对）；人群健康状况的测定与评价（B对）；药效评价和卫生管理决策（C对）。基础病理研究（D错，为本题正确答案）不属于生命质量评价主要应用的领域。